上述属于深部痛的是
A. 慢性腰腿痛
B. 韧带疼痛
C. 皮肤或黏膜疼痛
D. 急性炎症
E. 脏器穿孔

正确答案：B。韧带疼痛

解析：深部痛：内脏、肌腱、关节、韧带、骨膜等部位的疼痛，性质一般为钝痛，不局限，病人常只能笼统地说明疼痛部位（B对）。疼痛在躯体的解剖部位分类可分为头痛、颌面痛、颈项痛、肩周痛、上肢痛、胸痛、腹痛、腰背痛、盆腔痛、下肢痛、肛门痛、会阴痛等（A错）。浅表痛：位于体表皮肤或黏膜，性质多为锐痛，比较局限，定位明确（C错）。急性疼痛：如发生在创伤、手术、急性炎症、脏器穿孔等的即刻疼痛（DE错）。